男，35岁，已婚。因尿道口有脓性分泌物到医院就诊，被诊断为淋病。根据《传染病防治法》对传染病分类的规定，该患者所患疾病属于
A. 按乙类管理的丙类传染病
B. 丙类传染病
C. 甲类传染病
D. 按甲类管理的乙类传染病
E. 乙类传染病

正确答案：E。乙类传染病

解析：青中年男性，已婚。因尿道口有脓性分泌物到医院就诊，被诊断为淋病。根据《传染病防治法》对传染病分类的规定，淋病属于乙类传染病（E对）。流行性感冒、流行性腮腺炎、风疹、急性出血性结膜炎等属于丙类传染病（B错）。鼠疫、霍乱属于甲类传染病（C错）。传染性非典型肺炎、炭疽中的肺炭疽、人感染高致病性禽流感和脊髓灰质炎属于按甲类管理的乙类传染病（D错）。无按乙类管理的丙类传染病（A错）。